脉沉弱。其证候
A. 肾阴虚
B. 肾阳虚
C. 脾虚
D. 血瘀
E. 以上均非

正确答案：C。脾虚

解析：患者脾虚中气虚弱甚或下陷，则冲任不固，血失统摄，故经血淋漓不尽一年余，经血非时而至，经量甚多；气虚火不足，故经色色淡质稀；面色苍白是为缺血所致，气短懒言，大便不成形，舌淡，苔薄白，脉沉弱均为脾虚气弱之征（C对E错）。肾阴虚证除月经周期，量色质发生改变外，伴有头晕耳鸣，腰膝酸软，五心烦热，夜寐不宁等肾阴虚之征（A错）。肾阳虚证除月经周期及经量色质发生变化外，还伴有面色晦黯，肢冷畏寒，腰膝酸软，小便清长，夜尿多等肾阳虚之征（B错）。血疲证指瘀血停滞，导致血脉不通，壅塞或癖结不散而形成的病症，会伴有经色黯有血块，舌质紫黯或尖边有瘀点，脉弦细或涩等证候（D错）。